患者，男性，54岁。有糖尿病史，近几年因工作紧张患高血压：160/100mmHg。最好选用哪种降压药
A. 氢氯噻嗪
B. 可乐定
C. 氯沙坦
D. 普萘洛尔
E. 利血平

正确答案：C。氯沙坦